女性，26岁，末次月经是2007年4月25日，预产期应是
A. 2008年2月1日
B. 2008年1月2日
C. 2008年3月2日
D. 2008年1月30日
E. 2008年1月20日

正确答案：A。2008年2月1日

解析：整个预产周期约为40周（280天），预产期的计算方法是按末次月经第1日算起，月份减3或加9，日数加7。如果末次月经是2007年4月25日，预产期应是2008年2月1日（A对）。